牙髓炎的主要病因是
A. 咬合创伤
B. 化学刺激
C. 物理刺激
D. 细菌感染
E. 过敏反应

正确答案：D。细菌感染

解析：本题考查牙髓炎的病因。牙髓炎的主要病因是细菌感染（D对）。引起牙髓炎的原因有细菌感染、物理和化学刺激以及免疫反应等，其中细菌感染是导致牙髓炎的主要因素（D对BCE错）。咬合创伤属于致病因素中的物理因素（A错）。